男，26岁，5天来鼻及牙龈出血，皮肤瘀斑。血红蛋白55g/L，白细胞10.0×10⁹/L，血小板16×10⁹/L。骨髓增生极度活跃，绝大多数细胞呈清一色，胞浆内有大小不等颗粒及成堆Auer小体，过氧化酶染色强阳性。应首选的治疗
A. DA方案
B. 全反式维甲酸
C. 羟基脲
D. VP方案
E. 骨髓移植

正确答案：B。全反式维甲酸

解析：患者诊断为急性早幼粒细胞白血病（APL），治疗首选全反式维A酸（B对）可使早幼粒白血病细胞分化成熟，缓解率可高达70%～95%。DA方案（P576）（A错）是急性髓系白血病（非急性早幼粒细胞白血病）的首选治疗；羟基脲（P579）（C错）常用于慢性粒细胞白血病的治疗及降低白细胞处理；VP方案（P575）（D错）是急性淋巴细胞白血病的基础用药；骨髓移植（E错）可用于白血病缓解后的治疗。